23岁男性农民，11月份因发热头痛呕吐三天为主诉入院。体检：面颈部潮红，双腋下少许出血点，化验：尿常规蛋白（+）红细胞3～10个/HP，末梢血象：WBC23.0×10⁹/L，异型淋巴10%，PLT48×10⁹/L。住院二天后，热退但症状加重，出血点增加，四肢厥冷，脉搏细弱，BP：80/60mmHg，此时对该患者的治疗原则是
A. 以扩容为主
B. 以应用血管活性药物为主
C. 以应用激素为主
D. 以纠正酸中毒为主
E. 以输入胶体液为主

正确答案：A。以扩容为主

解析：23岁男性患者，职业农民（男性青壮年农民高发），11月份（流行性出血热高发季节）因发热、头痛、呕吐3天入院（流行性出血热发热期症状），出现发热头痛呕吐症状（流行性出血热发热期表现），面颈部潮红，双腋下少许出血点（出现毛细血管损害征），尿常规蛋白（+），红细胞3～10个/HP（肾功能损害征象），WBC23.0×10⁹/L（成人正常参考值4～10×10⁹/L），异型淋巴10％（淋巴细胞增多，并出现较多的异性淋巴细胞），PLT48×10⁹/L（成人正常参考值100～300×10⁹/L），根据患者的临床表现和实验室检查，该患者的诊断可能为流行性出血热，住院二天后（生病第四日），热退但症状加重，出血点增加，四肢厥冷，脉搏细弱，BP：80/60mmHg（发热末期血压下降），病程进展至低血压休克期，本期治疗原则应以补充血容量扩容为主（A对），宜早期、快速、适量，争取4小时内血压稳定。应用血管活性药物（B错），应用激素（C错），纠正酸中毒（D错）均可用于流行性出血热低血压休克期，补充血容量液体应晶胶结合，以平衡盐为主（E错）。